根据《处方药与非处方药分类管理办法（式行）》，负责非处方药目录审批的部门是
A. 国务院药品监督管理部门
B. 国家药典委员会
C. 国家劳动保障行政部门
D. 省级人民政府药品监督管理部门
E. 省级卫生行政管理部门

正确答案：A。国务院药品监督管理部门

解析：本题考查处方药和非处方药分类管理办法。根据《处方药和非处方药分类管理办法（试行）》，负责非处方药目录审批的部门是国家药品监督管理局（A对）。《处方药与非处方药分类管理办法（试行）》第四条：国家药品监督管理局负责非处方药目录的遴选、审批、发布和调整工作。